附子具有的功效是
A. 疏肝下气
B. 回阳救逆
C. 两者均是
D. 两者均不是

正确答案：B。回阳救逆

解析：本题考查的是附子的功效。附子具有的功效是回阳救逆（B对）。附子：【功效】回阳救逆，补火助阳，散寒止痛。吴茱萸：【功效】散寒止痛，疏肝下气（A错），燥湿止泻。